合成胆固醇的限速酶是
A. HMG-CoA合成酶
B. HMG-CoA裂解酶
C. HMG-CoA还原酶
D. 鲨烯环氧酶
E. 甲羟戊酸激酶

正确答案：C。HMG-CoA还原酶